有男尿道穿全长的是
A. 阴茎海绵体
B. 尿道海绵体
C. 阴茎头
D. 尿道球
E. 阴茎脚

正确答案：B。尿道海绵体

解析：尿道海绵体（B对）为尿道贯穿其全长，位于阴茎海绵体的腹侧。